不属于补阳还五汤组成药物的是
A. 黄芪
B. 当归尾
C. 赤芍
D. 地龙
E. 生地

正确答案：E。生地

解析：本题考查方剂的组成，补阳还五汤组成有黄芪（A错）、当归尾（B错）、赤芍（C错）、地龙（D错）、川芎、红花、桃仁。没有生地（E对）。